患者，男，66岁，BMI24kg/m²，高血压病史15年，冠心病史3年，目前规律服用阿司匹林、贝那普利、氨氯地平、美托洛尔、阿托伐他汀、螺内酯、呋塞米、单硝酸异山梨酯治疗。患者饮酒饱餐后出现胸闷，心前区疼痛，自服1片硝酸甘油不能缓解，来急诊科就诊。查体：血压163/83mmHg，心率80次1分。临床诊断为：（1）心绞痛急性发作；（2）心功能不全、心功能Ⅲ级；（3）高血压病3级；（4）高脂血症。能够改善该患者体液潴留的药物是
A. 氨氯地平
B. 阿托伐他汀
C. 呋塞米
D. 贝那普利
E. 美托洛尔

正确答案：C。呋塞米

解析：本题考查呋塞米。呋塞米（C对）、托拉塞米、布美他尼作为一类强效利尿药适用于大部分心力衰竭患者，特别适用于有明显液体潴留或伴肾功能受损的患者。氨氯地平（A错）属于钙通道阻滞剂，能够松弛血管平滑肌，降低心肌收缩力，减少心肌耗氧，改善心肌供血，保护缺血心肌细胞，发挥抗心绞痛作用；同时也能够降低血压，用于高血压的治疗。阿托伐他汀（B错）属于羟甲基戊二酰辅酶A还原酶抑制剂，其与羟甲基戊二酰辅酶A的结构相似，且对羟甲基戊二酰辅酶A还原酶的亲和力更大，对该酶产生竞争性的抑制作用，结果使血总胆固醇、低密度脂蛋白和载脂蛋白B水平降低，从而对动脉粥样硬化及冠心病的防治产生作用，还能够稳定和缩小动脉粥样硬化的脂质斑块，减少心血管事件发生。贝那普利（D错）为血管紧张素转换酶抑制剂，用于各期高血压；血性心力衰竭；作为对洋地黄和/或利尿剂反应不佳的充血性心力衰竭病人（NYHA分级Ⅱ-Ⅳ）的辅助治疗。美托洛尔（E错）是β受体阻断剂，可抑制心肌重构，改善临床左室功能，进一步降低总死亡率、降低心脏猝死率。